某男，3岁。2天来，停食停乳，腹胀便秘，痰盛喘咳。证属脾胃不和、痰食阻滞，治当消食导滞、祛痰通便，宜选用的成药是
A. 一捻金
B. 鹭鸶咯丸
C. 解肌宁嗽丸
D. 儿童清肺丸
E. 清宣止咳颗粒

正确答案：A。一捻金

解析：本题考查的是一捻金的功能。2天来，停食停乳，腹胀便秘，痰盛喘咳。证属脾胃不和、痰食阻滞，治当消食导滞、祛痰通便，宜选用的成药是一捻金（A对）。一捻金：【功能】消食导滞，祛痰通便。鹭鸶咯丸（B错）：【功能】宣肺，化痰，止咳。解肌宁嗽丸（C错）：【功能】解表宣肺，止咳化痰。儿童清肺丸（D错）：【功能】清肺，解表，化痰，止嗽。清宣止咳颗粒（E错）：【功能】疏风清热，宣肺止咳。